在龋病发生过程中有多种因素相互起作用，除了
A. 遗传
B. 微生物
C. 饮食
D. 时间
E. 宿主

正确答案：A。遗传

解析：龋病发生的四联因素理论认为龋病是一种多因素性疾病，有四种相互作用的主要因素在疾病发生过程中起作用，包括：宿主、微生物、饮食和时间。故答案为A。掌握“龋病概述”知识点。